不适合用作牙周病影像学检查方法的是
A. 根尖片
B. （牙合）翼片
C. 下颌骨侧位片
D. 曲面体层片
E. 根尖片数字减影技术

正确答案：C。下颌骨侧位片

解析：本题考查牙周病影像学检查方法。下颌骨侧位片（C错，为本题的正确答案）可以显示下颌磨牙后区及下颌升支的影像，常用于观察下颌骨体、升支及髁突的病变。根尖片（A对）可以完整显示某一牙齿的完整牙冠、牙根、牙周的影像，可显示牙槽骨吸收情况。根尖片数字减影技术（E对）则是通过数字化、各种减影处理及再成像等过程，去除无关影像使得图像更加清晰，更清楚的显示牙周情况。（牙合）翼片（B对）可以清晰地显示牙槽嵴顶，可用于确定是否有牙槽嵴顶的破坏性改变，适用于牙周炎的早期。曲面体层片（D对）可以显示全口整个上下颌牙体及牙周的影像，了解牙槽骨吸收的类型及程度，但清晰度不及根尖片。